听觉感受器是
A. 螺旋器
B. 椭圆囊斑
C. 球囊斑
D. 壶腹嵴
E. 蜗螺旋神经节

正确答案：A。螺旋器

解析：螺旋器位于螺旋膜上，是听觉感受器（A对）。椭圆囊斑（B错）、球囊斑（C错）、壶腹嵴（D错）三者均为位觉感受器。E选项在九版教材未明确。